日本血吸虫病的临床分型不包括
A. 急性血吸虫病
B. 异位血吸虫病
C. 晚期血吸虫病
D. 肝硬化型血吸虫病
E. 慢性血吸虫病

正确答案：D。肝硬化型血吸虫病

解析：日本血吸虫病分为急性血吸虫病（A对）、慢性血吸虫病（E对）、晚期血吸虫病（C对）以及异位血吸虫病（B对），不包括肝硬化型血吸病（D错，为本题正确答案）。